急性肾功能衰竭少尿期最常见的血镁、磷、钙代谢异常是
A. 高镁、高磷、低钙
B. 低镁、高磷、低钙
C. 高镁、低磷、高钙
D. 低镁、高磷、高钙
E. 高镁、高磷、高钙

正确答案：A。高镁、高磷、低钙

解析：急性肾功能衰竭少尿期最常见的血镁磷钙代谢异常是高镁高磷低钙（A对）。机体内钙离子和镁离子的调节是相互拮抗的，当钙离子降低时，会调节使镁离子浓度升高。